胆固醇合成的主要场所是
A. 肾
B. 肝
C. 小肠
D. 脑
E. 胆

正确答案：B。肝

解析：本题考查甘油磷脂、胆固醇和血脂蛋白代谢。肝（B对）是最主要的合成场所，其次是小肠。